确诊原发性免疫缺陷最重要的指标是
A. 白细胞计数和分类
B. 各类Ig的检测
C. T、B及吞噬细胞的功能的检测
D. 检测相关基因的缺陷
E. 补体成分的检测

正确答案：D。检测相关基因的缺陷

解析：原发性免疫缺陷病是免疫系统先天性发育不全所致，根据所累及的免疫细胞或组分可以是特异性免疫缺陷，如B细胞或T细胞缺陷、两者联合缺陷等；也可以是非特异性效应机制的缺陷，如补体或中性粒细胞缺陷。检测相关基因的缺陷是明确诊断重要的依据。掌握“免疫缺陷概述及原发性、获得性免疫缺陷病”知识点。